对固定酸的缓冲主要依靠
A. 血浆HCO₃⁻/H₂CO₃缓冲系统
B. 红细胞Hb⁻/HHb和HbO₂⁻/HHbO₂缓冲系统
C. 血浆HPO₄²⁻/H₂PO₄⁻缓冲系统
D. 血浆Pr⁻/HPr缓冲系统
E. 其他缓冲系统

正确答案：A。血浆HCO₃⁻/H₂CO₃缓冲系统

解析：对固定酸的缓冲主要依靠血浆HCO₃⁻/H₂CO₃缓冲系统（A对），体内挥发酸的缓冲主要靠非碳酸氢盐缓冲系统。